可减慢肠蠕动，引起便秘排黑便的药物是
A. 维生素D
B. 维生素C
C. 复合维生素B
D. 葡萄糖酸钙
E. 硫酸亚铁

正确答案：E。硫酸亚铁

解析：本题考查药物的不良反应。可减慢肠蠕动，引起便秘排黑便的药物是硫酸亚铁（E对）。硫酸亚铁主要用于缺铁性贫血。铁剂可减少肠蠕动，引起便秘，服用后可见胃肠道不良反应，如恶心、便秘、排黑便等。维生素D（A错）用于治疗佝偻病。慢性肾衰、高钙血症、高磷血症伴肾性佝偻病禁用。复合维生素B（C错）用于预防和治疗B族维生素缺乏所致的营养不良、厌食、脚气并糙皮病等。大量服用可出现烦躁、疲倦、食欲减退，尿液呈黄色。葡萄糖酸钙（D错）用于预防和治疗钙缺乏症。